小儿语言发育三个阶段的顺序是
A. 发音、理解、表达
B. 理解、表达、发音
C. 表达、理解、发音
D. 听觉、发音、理解
E. 模仿、表达、理解

正确答案：A。发音、理解、表达

解析：语言的发育与大脑、咽喉部肌肉的正常发育及听觉的完善有关，小儿语言发育三个阶段的顺序是发音、理解、表达（A对）。